脏腑虚衰，气血不足，运化无力，致腹部胀满，呼吸喘促，二便闭塞等。此为
A. 真热假寒
B. 真实假虚
C. 真虚假实
D. 不虚不实
E. 真寒假热

正确答案：C。真虚假实

解析：真虚假实，是指病机的本质为“虚”，但表现出“实”的临床假象。一般是由于正气虚弱，脏腑经络气血不足，功能减退，气化无力所致。“脏腑虚衰，气血不足，运化无力”是本质，本质为虚；“腹部胀满，呼吸喘促，二便闭塞”是“至虚有盛候”的临床假象，故其病机为真虚假实（C对）。